可交给病员自用的药物有
A. 10％碘甘油
B. 2.5％碘甘油
C. 碘酚
D. 碘氧
E. 以上均可

正确答案：B。2.5％碘甘油

解析：本题考查可交给病员自用的药物。碘甘油具有一定的抑菌、消炎收敛作用，用于牙周病的局部药物治疗。碘甘油有一定的刺激性，低浓度（2.5％）碘甘油（B对）可交给病员自用，高浓度（10％）碘甘油（A错）需由医师使用。碘酚（C错）含碘和酚，为腐蚀性较强的药物，必须由专业医师使用。牙周病碘氧（D错）治疗是将碘化钾溶于过氧化氢内，析出新生态的氧及碘分子，从而发生较强的杀菌作用。治疗过程中产生的黄色气泡可能会污染衣物，如果局部隔湿不好，产生的氢氧化钾会对健康组织造成腐蚀。